治疗中风闭证，除选太冲、劳宫外还应加
A. 支沟
B. 水沟
C. 下关
D. 中冲
E. 丰隆

正确答案：B。水沟

解析：中风主穴为内关、水沟，闭证加十二井穴、太冲、合谷。内关调心神，水沟醒脑开窍，内关用泻法；水沟用雀啄法，以眼球湿润为佳。